覆盖在游离龈龈沟内壁的牙龈上皮为
A. 结合上皮
B. 龈沟上皮
C. 龈谷上皮
D. 上皮根鞘
E. 口腔黏膜上皮

正确答案：B。龈沟上皮

解析：龈沟上皮的部位是牙龈上皮在游离龈的边缘转向内侧覆盖龈沟壁的上皮。掌握“牙龈”知识点。